支配消化道的副交感神经兴奋时，下述哪一种活动不增强
A. 胃液分泌
B. 胰液分泌
C. 胃的运动
D. 小肠运动
E. 支配消化道的交感神经活动

正确答案：E。支配消化道的交感神经活动